阴阳学说的基本内容有
A. 相互制约
B. 互根互用
C. 消长平衡
D. 相互转化
E. 相互对立

正确答案：A、B、C、D、E。相互制约；互根互用；消长平衡；相互转化；相互对立

解析：本题考查的是阴阳的相互关系。阴阳学说的基本内容有相互制约（A对）、互根互用（B对）、消长平衡（C对）、相互转化（D对）与相互对立（E对）。阴阳的对立制约、互根互用、消长平衡和相互转化，说明阴和阳之间的相互关系不是孤立的、静止不变的，它们之间是相互联系的。阴阳对立互根，是事物之间或事物内部所存在的固有属性；阴阳消长转化，是事物量变和质变的运动变化形式。在一定限度内，阴阳消长运动是绝对的，平衡则是相对的；在一定的条件下，阴阳消长运动可以由量变产生质变，从而形成阴阳转化，这就是中医阴阳学说的主要内容。